可作为栓剂吸收促进剂的是
A. 白蜡
B. 聚山梨酯80
C. 叔丁基对甲酚
D. 单硬脂酸甘油酯
E. 凡士林

正确答案：B。聚山梨酯80

解析：本题考查栓剂的附加剂。聚山梨酯80（B对）可作为栓剂的吸收促进剂；白蜡（A错）为栓剂的硬化剂；叔丁基对甲酚（C错）为栓剂的抗氧化剂；单硬脂酸甘油酯（D错）为栓剂的增稠剂；凡士林（E错）一般作为软膏剂的油性基质。